女性，45岁。肥胖多年，口渴5个月，尿糖（+），空腹血糖7.9mmol/L，饭后2小时血糖12.1mmol/L。病人可诊断
A. 1型糖尿病
B. 肾性糖尿
C. 食后糖尿
D. 2型糖尿病
E. 类固醇性糖尿病

正确答案：D。2型糖尿病

解析：中年女性患者（2型糖尿病常见人群），肥胖多年（2型糖尿病易感因素），口渴5个月（常见症状），尿糖（+），空腹血糖7.9mmol/L，饭后2小时血糖12.1mmol/L，符合糖尿病诊断标准，因此本例患者最可能的诊断为2型糖尿病（D对）。1型糖尿病（A错）多为青少年起病，常见多饮、多食、多尿及消瘦表现。肾性糖尿（B错）多有肾脏疾病相关病史，血糖在正常范围。食后糖尿（C错）为进食含糖食物后出现一过性尿糖阳性，可见于胃空肠吻合术后、甲亢等病人胃肠道吸收糖类过快，导致血糖升高与尿糖阳性，但其空腹血糖一般正常。类固醇性糖尿病（E错）见于库欣综合征患者，大量皮质醇引起血糖升高，常伴有向心性肥胖、满月脸、多血质外貌及其他系统临床表现。